由载体介导的易化扩散发生饱和现象的机制是
A. 跨膜浓度梯度降低
B. 载体特异性较差
C. 跨膜电位梯度降低
D. 物质转运能量不足.
E. 载体转运达极限

正确答案：E。载体转运达极限